个案调查
A. 设立对照组
B. 盲法观察
C. 两者均有
D. 两者均无

正确答案：D。两者均无

解析：本题考查个案调查的概念。个案调查，又称个案研究，是描述性研究的一种，指到发病现场对新发病例的接触史、家属及周围人群的发病或健康状况以及可能与发病有关的环境因素进行调查，以达到查明所研究病例的发病原因和条件，控制疫情扩散及消灭疫源地，防止再发生类似疾病的目的。个案调查不设立对照组，也不采用盲法的研究方法，因此两项均不正确（D对ABC错）。